小儿，2个月，发热一天，咳嗽3天，有痰咳不出，偶有喘息，哺乳时明显，三凹征（-），双肺未闻及中小湿啰音，心脏听诊正常，最可能诊断是
A. 支气管肺炎
B. 支气管炎
C. 上呼吸道感染
D. 支气管哮喘
E. 支气管扩张

正确答案：B。支气管炎

解析：患儿发热、咳嗽、偶有喘息，哺乳时明显，双肺未闻及中小湿啰音，诊断为支气管炎，急性感染早期病理表现为支气管黏膜充血、肿胀，继而浅层纤毛上皮损伤、脱落，黏液腺肥大，分泌物增加，黏膜下层有炎性细胞浸润（B对）。支气管肺炎肺部听诊特点为双肺固定的细湿啰音（A错）。上呼吸道感染肺部听诊一般没有啰音，只能听到较为粗糙的呼吸音（C错）。支气管哮喘肺部听诊为哮鸣音（D错）。支气管扩张早期没有什么明显典型的体征，一般在呼吸合并感染，同时如果有咯血、气喘症状，可以听到干湿性啰音，啰音一般都比较局限性（E错）。